18岁男性，右颌下区无痛性质软肿物发现三月，表面皮肤正常，口内检查亦未见异常。行颌下手术时见肿物呈囊性，术中囊壁破裂，流出粘稠而略带黄色蛋清样液体，遂将囊壁及颌下腺一并摘除，但术后不久囊肿复发。该病最可能的诊断是
A. 颌下腺囊肿
B. 潜突型舌下腺囊肿
C. 颌下区软组织囊肿
D. 囊性水瘤
E. 鳃裂囊肿

正确答案：B。潜突型舌下腺囊肿

解析：本题考查舌下腺囊肿。潜突型舌下腺囊肿（B对）要表现为下颌下区肿物，而口底囊肿表现不明显；触诊柔软，与皮肤无粘连，不可压缩，低头时因重力关系，肿物稍有增大；穿刺时可抽出蛋清样黏稠液体。下颌下区囊性水瘤（D错）常见于婴幼儿，穿刺检查见囊腔内容物稀薄，无黏液，淡黄清亮，涂片镜检可见淋巴细胞。鳃裂囊肿（E错）可根据病史、临床表现及穿刺检查作出诊断，作穿刺抽吸时，可见有黄色或棕色的、清亮的、含或不含胆固醇的液体；鳃裂瘘可时有黏液样分泌物（第一鳃裂瘘可伴有皮脂样分泌物）溢出。